孕35周，子痫，抽搐控制6小时，此时应采取的措施是
A. 人工破膜
B. 剖宫产
C. 引产
D. 会阴侧切
E. 低位产钳术

正确答案：B。剖宫产

解析：该患者已诊断为子痫，抽搐控制6小时（＞2小时），应立即终止妊娠，应采取的措施是剖宫产（B对）。人工破膜（A错）、引产（C错）、会阴侧切（D错）、低位产钳术（E错）均不能够短时间内终止妊娠，病情有可能加重。